治疗麻风和广谱抗菌的是
A. 链霉素
B. 乙胺丁醇
C. 异烟肼
D. 氯喹
E. 利福平

正确答案：E。利福平

解析：利福平是广谱抗菌药，对结核分枝杆菌、麻风杆菌（E对）、革兰氏阳性菌尤其耐药性金黄色葡萄球菌有强大的抗菌作用；较大浓度时对革兰氏阴性菌、某些病毒和沙眼衣原体也有抑制作用。链霉素（A错）是氨基糖苷类，主要用于敏感需氧革兰氏阴性杆菌所致的全身感染，并非广谱抗菌。乙胺丁醇（B错）对繁殖期结核杆菌有较强的抑制作用，而对其他细菌无效。异烟肼（C错）对结核杆菌具有高度选择性，对生长旺盛的活动期结核杆菌有较强的杀灭作用，是治疗结核病的首选药物。氯喹（D错）是抗疟药，控制症状发作和预防性控制疟疾症状发作。